以下不属于可复性牙髓炎表现的是
A. 食物嵌入痛
B. 冷热刺激痛
C. 酸甜刺激痛
D. 接近牙髓组织的牙体缺损
E. 自发性疼痛

正确答案：E。自发性疼痛

解析：本题考查可复性牙髓炎的表现。可复性牙髓炎牙髓炎症轻微，无自发性痛（E错，为本题的正确答案），自发痛常见于不可复性牙髓炎中的急性牙髓炎。可复性牙髓炎是牙髓组织以血管扩张、充血为主要病理变化的初期炎症表现，若彻底去除作用于患牙上的病源刺激因素，同时给予患牙适当的治疗，患牙的牙髓是可以恢复到原有状态的。患牙常见有接近髓腔的牙体硬组织病损（D对），如深龋、深楔状缺损；或可查及患牙有深牙周袋；也可受累于咬合创伤或过大的正畸外力。深龋时若出现食物嵌入痛（A对），食物去除后疼痛立即消失，说明牙髓处于充血状态。冷热刺激激（B对）、酸甜刺激痛（C对）引起牙髓一过性敏感，刺激去除后疼痛立即消失。